流行性出血热治疗原则为补充血容量，纠正酸中毒，改善微循环的时期是
A. 发热期
B. 低血压休克期
C. 少尿期
D. 多尿期
E. 恢复期

正确答案：B。低血压休克期

解析：流行性出血热各期的治疗原则如下所述：（1）发热期（A错）：①一般治疗：绝对卧床休息，给予营养丰富、易消化饮食；②抗病毒治疗；③改善中毒症状和对症治疗；④预防DIC。（2）低血压休克期（B对）：①补充血容量，强调“一早”、“二快”、“三适量”；②纠正酸中毒；③强心剂的应用；④血管活性药物与糖皮质激素的应用。（3）少尿期（C错）：①稳定内环境；②促进利尿；③导泻疗法；④透析疗法。（4）多尿期（D错）：①稳定内环境；②预防感染；③支持疗法。（5）恢复期（E错）：注意休息，逐渐增加活动量，加强营养。